脂质体的质量要求中，检查项目不包括
A. 粒径
B. 包封率
C. 载药量
D. 渗漏率
E. 沉降体积比

正确答案：E。沉降体积比

解析：本题考查脂质体的质量要求。脂质体的质量要求中，检查项目不包括沉降容积比（E错，为本题正确答案）。脂质体的质量要求包括粒径、包封率、载药量、、渗漏率，不包括沉降容积比。